容易早期发生肺部转移的口腔颌面部肿瘤是
A. 牙龈癌
B. 舌癌
C. 黏液表皮样癌
D. 颊癌
E. 腺样囊性癌

正确答案：E。腺样囊性癌

解析：本题考查腺样囊性癌。容易早期发生肺部转移的口腔颌面部肿瘤是腺样囊性癌（E对）。腺样囊性癌易侵入血管，转移率高，转移部位以肺为最多见，早晚期均可发生。上牙龈癌（A错）可侵入上颌窦及腭部；下牙龈癌（A错）可侵及口底及颊部，多转移到患侧下颌下及颏下淋巴结，以后到颈深淋巴结。晚期舌癌（B错）可蔓延至口底及下颌骨，向后发展可以侵犯腭舌弓及扁桃体，且常发生早期颈淋巴结转移且转移率较高。高分化黏液表皮样癌（C错）如手术切除不彻底，术后可以复发，但很少发生颈淋巴结转移，血行性转移更少见，低分化黏液表皮样癌淋巴结转移率较高，且可出现血行性转移。颊癌（D错）常转移至面淋巴结，下颌下及颈深上淋巴结，有时也可转移至腮腺淋巴结，远处转移较少见。